男，71岁，高血压20年，规律服用福辛普利及氢氯噻嗪10年，近2年出现活动耐量下降，伴夜间憋醒，1周来患者感心悸，不能平卧，查体：P100次/分，BP200/130mmHg，双肺底可闻及湿性罗音，心率128次/分，心律不齐，S1强弱不等，心尖部可闻及2/6级收缩期杂音，考虑此患者是急性心力衰竭患者，请问以下最可能的病因是
A. 高血压危象
B. 心肌炎
C. 年龄偏大
D. 性别
E. 急性肺栓塞

正确答案：A。高血压危象

解析：急性左心力衰竭常由前面提到的诱因导致急性加重。常见的病因有：1)急性冠脉综合征（ACS）。2)急性心肌梗死的机械并发症乳头肌断裂所致的急性二尖瓣反流、室间隔穿孔、心脏游离壁破裂和心脏压塞。3)急性肺栓塞。4)高血压危象。5)心肌炎。6)快速性心律失常和严重心动过缓/传导阻滞。7)其他。掌握“心力衰竭”知识点。